传统银合金粉与汞的重量比略大于
A. 1
B. 2
C. 3
D. 4
E. 5

正确答案：A。1

解析：本题考查牙体充填材料之银汞合金。将汞与合金粉按适当的比例混合、研磨成均质的团块。传统银合金粉与汞的重量比略大于1（A对）。